女，20岁。活动后胸闷、气短2天。3周前曾咳嗽、持续发热1周。既往体健。查体：面色苍白、双肺呼吸音清，心界向左下扩大，心率120次/分，频发早搏，第一心音减弱，P₂＞A₂，心尖区可闻见2/6级收缩期杂音。实验室检查：血肌钙蛋白增高。该患者最可能的诊断是
A. 病毒性心肌炎
B. 急性心肌梗死
C. 急性肺栓塞
D. 慢性心力衰竭
E. 感染性心内膜炎

正确答案：A。病毒性心肌炎

解析：患者青少年女性，活动后胸闷、气短，3周前曾咳嗽持续发热1周（提示病毒感染史），查体：心率增快，频发早搏，心尖区可闻见2/6级收缩期杂音，实验室检查：血肌钙蛋白增高，患者临床表现与及检查与病毒性心肌炎相符，故该患者最可能的诊断是病毒性心肌炎（A对）。急性心肌梗死（P234）（B错）虽可有血肌钙蛋白升高、心率增快，但一般起病急骤，常伴特征性的心电图改变，多无前驱感染病史。急性肺栓塞（P100）（C错）主要表现为突然发生的呼吸困难、剧烈胸痛、发热、咯血等。慢性心力衰竭（P166）（D错）多发生于老年患者，主要表现为劳力性呼吸困难、颈静脉怒张、水肿等。感染性心内膜炎（P309）（E错）多有发热、心脏瓣膜可变杂音等体征，不会出现血清肌钙蛋白升高。